某女，23岁。突发心悸半小时，自数脉率为180次/分，脉率齐。将面部沉浸在冰水中心悸突然好转，自数脉率为70次/分，脉率齐。冷刺激使其症状缓解的最主要机制是
A. 房室交界区不应期延长
B. 窦房结细胞自律性增强
C. 异常传导的兴奋性增高
D. 房室延搁时间缩短
E. 房室交界区细胞4期自动去极化减弱

正确答案：E。房室交界区细胞4期自动去极化减弱

解析：患者青年女性，突发心悸半小时，脉率为180次/分（室上速心室率为150-250次/分），脉率齐，诊断为阵发性室上速。治疗阵发性室上速可先尝试刺激迷走神经的方法：颈动脉窦按摩（患者取仰卧位，先行右侧，每次5-10秒，切莫双侧同时按摩）、Valsalva动作（深吸气后屏气、再用力作呼气动作）、诱导恶心、将面部浸没于冰水内等方法可使心动过速终止。冷刺激使阵发性室上速缓解的机制是刺激迷走神经，释放的递质ACh则可增加外向钾电流而降低内向电流，使房室交界区细胞4期自动去极化减弱（E对）。由于迷走神经对心脏有抑制作用，不会使窦房结细胞自律性增强（B错）、房室延搁时间缩短（D错）。房室交界区不应期延长（A错）、异常传导通路的兴奋性增强（C错）均与冷刺激导致的心率减慢无关。